呼吸功能不全而发生的缺氧，其动脉血中最具特征性的变化是
A. 氧分压降低
B. 氧容量低
C. 氧含量降低
D. 氧饱和度降低
E. 氧离曲线右移

正确答案：A。氧分压降低

解析：动脉血中氧分压降低（A对）是呼吸功能不全而发生的乏氧性缺氧最具特征性的变化。氧容量低（B错）、氧含量降低（C错）、氧饱和度降低（D错）、氧离曲线右移（E错）都不是呼吸功能不全而发生的乏氧性缺氧最具特征性的变化。